不属于妊娠期妇女口腔健康维护的内容是
A. 重点做好妊娠期龈炎的防治
B. 认真刷牙
C. 使用有抗菌作用的漱口水
D. 认真进行日常口腔清洁维护
E. 定期进行牙周手术

正确答案：E。定期进行牙周手术

解析：妊娠期妇女口腔健康维护的内容：孕妇应认真进行每日的口腔清洁维护，方法包括采用机械性和化学性菌斑控制方法。要重点做好妊娠期龈炎的防治，除认真刷牙外，必要时可配合使用有抗菌作用的漱口水，以保持口腔环境的清洁。掌握“妊娠期妇女口腔保健”知识点。